幽门梗阻病人可发生
A. 呼吸性酸中毒
B. 代谢性酸中毒
C. 呼吸性碱中毒
D. 代谢性碱中毒
E. 呼吸性酸中毒合并代谢性碱中毒

正确答案：D。代谢性碱中毒

解析：幽门梗阻病人反复呕吐，大量酸性胃液丢失，可导致的应为代谢性碱中毒（D对）。代谢性碱中毒通常由体内丢失H⁺（如胃液丢失过多）或HCO₃⁻增多（如长期服用碱性药物）引起。呼吸性酸中毒（A错）是指由于呼吸原因使得体内CO₂蓄积，PaCO₂增高。常见原因有：全身麻醉过深、镇静剂过量、中枢神经系统损伤、气胸、急性肺水肿和呼吸机使用不当等。代谢性酸中毒（B错）常见病因为碱性物质丢失过多、酸性物质产生过多和肾功能不全。呼吸性碱中毒（C错）是由于肺泡通气过度，体内产生的CO₂排出过多，以致血PaCO₂降低，最终引起低碳酸血症，血pH上升。常见原因有：癔症、忧虑、疼痛、发热、创伤、中枢神经系统疾病、低氧血症、肝功能衰竭，以及呼吸机辅助通气过度等。